干燥失重不得超过2.0%的剂型是
A. 气雾剂
B. 颗粒剂
C. 胶囊剂
D. 软膏剂
E. 膜剂

正确答案：B。颗粒剂

解析：本题考查颗粒剂。颗粒剂（B对）的干燥失重不得超过2.0%；气雾剂（A错）、胶囊剂（C错）、软膏剂（D错）、膜剂（E错）无需进行干燥失重检查。